28岁，孕34周。10天前开始感觉乏力，食欲差，近5天病情加重，伴呕吐，巩膜发黄，神志欠清而入院，血压135/90mmHg，ALT35U/L，胆红素176μmol/L，尿蛋白（-）。最佳诊断是
A. 妊娠脂肪肝
B. 妊娠肝内胆汁淤积症
C. 妊娠高血压肝损害
D. 药物性肝损害
E. 妊娠合并重症肝炎

正确答案：E。妊娠合并重症肝炎

解析：孕妇乏力，食欲差，伴呕吐，巩膜发黄，ALT35U/L（正常值0～40U/L），胆红素176umol/L（正常值1.71～17.1umol/L），根据临床表现和实验室检查，最可能的诊断是妊娠合并重型肝炎（E对）。妊娠脂肪肝（A错）的常见临床表现为持续性恶心呕吐、乏力、上腹痛或头痛，数天至1周出现黄疸，进行性加深。妊娠肝内胆汁淤积症（P073）（B错）的常见临床表现为瘙痒、黄疸、皮肤抓痕、一般无明显消化道症状。妊娠期高血压肝损害（C错）时出现各种转氨酶水平升高，血浆碱性磷酸酶升高，常伴有蛋白尿或随机蛋白尿。药物性肝损害（D错）是在药物使用过程中，因药物本身及其代谢产物或由于特殊体质对药物的超敏感性或耐受性降低所导致的肝损伤，由于题干中没有提到患者服用某种药物，因此药物性肝损害不是最佳诊断。